影响外用膏剂中药物透皮吸收的因素有
A. 应用部位
B. 应用面积
C. 基质的组成
D. 基质的pH值
E. 药物的溶解性

正确答案：A、B、C、D、E。应用部位；应用面积；基质的组成；基质的pH值；药物的溶解性

解析：本题考查的是影响外用膏剂中药物透皮吸收的因素。影响外用膏剂中药物透皮吸收的因素有应用部位（A对）、应用面积（B对）、基质的组成（C对）、基质的pH值（D对）与药物的溶解性（E对）。影响外用膏剂中药物透皮吸收的因素：（1）皮肤条件：①应用部位：皮肤的厚薄、毛孔的多少等与药物的穿透、吸收均有关系。不同年龄和性别，由于皮肤条件不同，对药物的穿透、吸收影响也不同。②皮肤的病变：皮肤烧伤、溃疡破损时，药物可自由地进入真皮，吸收的速度和程度大大增加，但可能引起疼痛、过敏及中毒等不良反应。某些皮肤病使角质层致密硬化，则不利于药物的透过。③皮肤的温度与湿度：皮肤温度提高，皮下血管扩张，血流量增加，可加速吸收。皮肤湿度大，有利于角质层的水合作用，致角质层肿胀，细胞间疏松，有利于吸收。④皮肤的清洁：洗涤可除去部分角质层以及毛囊、皮脂腺上的堵塞物，有利于药物的透过。（2）药物性质：皮肤细胞膜具有类脂质特性，一般脂溶性药物比水溶性药物易穿透皮肤，而组织液是极性的，因此，具有适宜的油、水分配系数，既有一定脂溶性又有一定水溶性的药物透皮吸收较理想。在油和水中都难溶的药则很难透皮吸收。强亲油性药物可能聚积在角质层表面而难以透过，通常，药物相对分子质量愈大，经皮吸收愈慢，故经皮吸收制剂宜选用相对分子质量较小，药理作用强的药物。（3）基质的组成与性质：①基质组成、类型和性质：直接影响药物的释放、穿透和吸收。一般认为药物的吸收在乳状液型基质中最好，在吸水性软膏基质（凡士林加羊毛脂）、硅酮及豚脂中次之，在烃类基质中最差。若基质的组成与皮脂分泌物类似，则利于某些药物透过皮肤。水溶性基质聚乙二醇对药物的释放较快，但对药物的穿透作用影响不大，制成的软膏较难透皮吸收。②基质的pH：影响酸性和碱性药物的吸收。当基质pH小于弱酸性药物的pKₐ或大于弱碱性药物的pKₐ时，药物的分子型显著增加而利于吸收。③附加剂：基质中添加表面活性剂、透皮促进剂（如月桂氮酮）等能增加药物的穿透性，有利于吸收。④基质对皮肤的水合作用：增加皮肤的水合作用的基质，能增加药物的渗透性。其中油脂性基质封闭性强，可显著增加皮肤的水合作用。（4）其他因素：药物的透皮吸收除上述影响因素外，还与药物浓度、应用面积、应用次数及与皮肤接触时间等密切相关。